下列哪项属于平性食物
A. 莲子，糯米
B. 丝瓜，小米
C. 胡桃仁，黄豆
D. 扁豆，绿豆
E. 小米，牛奶

正确答案：C。胡桃仁，黄豆

解析：桃仁味甘、苦，性平；黄豆性味甘、性平（C对）。莲子药性平和，味道甘、涩；糯米味甘，性温（A错）。丝瓜味甘，性凉；小米味甘、咸，性寒凉（B错）。扁豆味甘，性偏温；绿豆味甘，性寒（D错）。小米味甘、咸，性寒凉；牛奶味甘、性偏寒（E错）。